在Ab产生的一般规律中，初次应答产生最早，具有早期诊断价值的Ig是
A. IgG
B. IgM
C. SIgA
D. IgE
E. IgD

正确答案：B。IgM